可区分三萜皂苷和甾体皂苷的是
A. 五氯化锑反应
B. 氯仿-浓硫酸反应
C. 三氯化铁反应
D. 醋酐-浓硫酸反应
E. Molish反应

正确答案：D。醋酐-浓硫酸反应

解析：本题考查的是皂苷类化合物的显色反应。可区分三萜皂苷和甾体皂苷的是醋酐-浓硫酸反应（D对）。醋酐-浓硫酸（Liebermann-Burchard）反应：将样品溶于醋酐中，加入浓硫酸-醋酐（1：20）数滴，显色，颜色变化与Liebermann反应相同。此反应可以区分三萜皂苷和甾体皂苷，前者最后呈红色或紫色，后者最终呈蓝绿色。五氯化锑反应（A错）为皂苷的显色反应，是将皂苷样品溶于三氯甲烷或醇后，点于滤纸上，喷以20%五氯化锑的三氯甲烷溶液（不应含乙醇和水），干燥后60℃～70℃加热，显蓝色、灰蓝色或灰紫色斑点。氯仿-浓硫酸反应（B错）即Salkowski反应，为强心苷甾体母核的颜色反应。是将样品溶于三氯甲烷，沿管壁缓缓加入浓硫酸，硫酸层显血红色或蓝色，三氯甲烷层显绿色荧光。三氯化铁反应（C错）为香豆素类化合物的显色反应。具有酚羟基的香豆素类可与三氯化铁试剂产生颜色反应，通常是蓝绿色。Molish反应（E错）为糖的显色反应，常用的试剂由浓硫酸和α-萘酚组成。可生成有色物质，可借此来检识糖和苷类化合物的存在。